巴比妥类药物急性中毒的解救措施包括
A. 保持呼吸道通畅，吸氧
B. 必要时进行人工呼吸
C. 应用中枢兴奋药
D. 静脉滴注碳酸氢钠
E. 透析治疗

正确答案：A、B、C、D、E。保持呼吸道通畅，吸氧；必要时进行人工呼吸；应用中枢兴奋药；静脉滴注碳酸氢钠；透析治疗

解析：本题考查巴比妥类药物中毒的解救。对巴比妥类急性中毒者，应维持其呼吸与循环功能，保持呼吸通畅，吸氧（A对）、必要时人工呼吸（B对），甚至切开气管，也可用中枢兴奋药（C对）。 为加速排泄，可用碳酸氢钠静滴（D对），严重中毒者用透析疗法（E对）。